舌下神经核上瘫出现
A. 对侧鼻唇沟变浅或消失
B. 伸舌舌尖偏向病灶的对侧
C. 同侧异唇沟变浅或消失
D. 伸舌舌尖偏向病灶同侧
E. 无

正确答案：B。伸舌舌尖偏向病灶的对侧

解析：一侧舌下神经核核上瘫，可产生对侧眼裂以下的面肌和对侧舌肌瘫痪，表现伸舌舌尖偏向病灶的对侧（B对D错），口角低垂并歪向病灶侧，流涎，不能作鼓腮、露齿。其面肌并不瘫痪，因此鼻唇沟并没有改变（AC错）。